女婴，10个月，发热咳嗽5天，烦躁呕吐2天，抽搐2次。查体，40℃，嗜睡，前卤隆起，呼吸急促，双肺闻及细湿啰音，颈无抵抗，双侧巴氏症阳性，脑脊液检查，外观浑浊，白细胞800×10⁹/L，N0.80，L0.20，蛋白质2g/L，糖1.2mmol/L，氯化物102mmol/L，涂片找菌阴性，PPD阴性。假设信息，患儿经治疗后好转，3日后再次发热，呕吐，惊厥发作。首选检查为
A. 肌电图
B. MRI
C. 心电图
D. CT
E. 硬膜下穿刺

正确答案：E。硬膜下穿刺

解析：女婴，10个月（2岁以内发病者约占75%），发热咳嗽5天，烦躁呕吐2天，抽搐2次（急性脑功能障碍症状）。查体，40℃，嗜睡，前卤隆起，呼吸急促（颅内压增高表现），双肺闻及细湿啰音，颈无抵抗，双侧巴氏症阳性（脑膜刺激征），脑脊液检查，外观浑浊，白细胞800×10⁹/L（白细胞总数≥1000x/L），N0.80，L0.20，蛋白质2g/L，糖1.2mmol/L，氯化物102mmol/L，涂片找菌阴性，PPD阴性（无结核分枝杆菌）患儿最可能诊断的是化脓性脑膜炎。假设信息，患儿经治疗后好转，3日后再次发热，呕吐，惊厥发作（颅内压增高表现）。出现并发症硬脑膜下积液，最后确诊有赖硬膜下穿刺放出积液，同时也达到治疗目的（E对）。头颅 MRI 较CT（D错）更能清晰地反映脑实质病变，在病程中重复检查能发现并发症。并指导干预措施的实施增强显影虽非常规检查（B错），但能显示脑膜强化等炎症改变。心电图肌电图与本病无关（AC错）。